公共场所的主要特点
A. 人群密集，非健康个体混杂，易混杂各种污染源
B. 人群密集，健康个体混杂，易混杂各种污染源
C. 人群密集，流动性小，健康与非健康个体混杂，易混杂各种污染源
D. 人群密集，流动性大，健康与非健康个体混杂，易混杂各种污染源
E. 人群固定，流动性小，健康与非健康个体混杂，易混杂各种污染源

正确答案：D。人群密集，流动性大，健康与非健康个体混杂，易混杂各种污染源

解析：本题考查公共场所的主要特点。公共场所是根据公众生活活动和社会活动的需要，人工建成的具有多种服务功能的公共建筑设施，供公众进行学习、工作、休息、文体、娱乐、参观、旅游、交流、交际、购物、美容等活动之用。其主要特点是：人群密集，流动性大，健康与非健康个体混杂，易混杂各种污染源（D对ABCE错）。